能够用于反流性食管炎的是
A. 伏诺拉生
B. 铝碳酸镁
C. 奥美拉唑
D. 枸橼酸铋钾
E. 雷尼替丁

正确答案：A、B、C、E。伏诺拉生；铝碳酸镁；奥美拉唑；雷尼替丁

解析：本题考查反流性食管炎治疗药物。伏诺拉生（A对）、铝碳酸镁（B对）、奥美拉唑（C对）、雷尼替丁（E对）均可用于治疗反流性食管炎。